不是矽肺诊断主要依据的是
A. 接触粉尘的职业史
B. 临床症状
C. CT检查
D. 胸片
E. 肺功能检查

正确答案：C。CT检查

解析：矽肺是尘肺中的一种类型，应根据可靠的接触粉尘职业史（A对）、技术质量合格的后前位X线胸片（D对）及现场劳动卫生学调查资料，结合临床表现和实验室检查等作出诊断。矽肺的临床表现中包括临床症状与体征、X线胸片表现及肺功能变化，因此临床症状（B对）、胸片（D对）及肺功能检查（E对）均可作为矽肺诊断依据，CT检查不是矽肺诊断的主要依据（C错，为本题正确答案）。